患者，女，67岁，高血压、2型糖尿病、冠心病病史13年，既往血压最高达到180/115mmHg。规律服用氨氯地平、比索洛尔、西格列汀、二甲双胍，3年前发生缺血性脑卒中。近期记忆力下降明显，伴认知功能障碍加重入院。查体：血压155/95mmHg，心率92次/分，呼吸14次/分，体温36.5℃。意识清，少语，动作迟缓，空间感、时间感、计算力、近记忆力、定向力下降，共济运动检查欠合作；影像提示：脑内多发陈旧性缺血梗死灶、脑室扩大、脑萎缩、左侧大脑中动脉纤细合并局限性狭窄。诊断为血管性痴呆、高血压3级（很高危）、2型糖尿病、冠心病。可用于改善该患者认知功能障碍的药物是
A. 苯海索
B. 丁苯酞
C. 倍他司汀
D. 多奈哌齐
E. 司来吉兰

正确答案：D。多奈哌齐

解析：本题考查改善脑功能药物。目前，临床用于脑功能改善及抗记忆障碍药，按其作用机制可分为：酰胺类中枢兴奋药、乙酰胆碱酯酶抑制剂和其他类。多奈哌齐（D对）为乙酰胆碱酯酶抑制剂。